隐睾最严重的后果是
A. 睾丸扭转
B. 睾丸炎
C. 不育
D. 睾丸恶变
E. 睾丸萎缩

正确答案：D。睾丸恶变

解析：隐睾症是指睾丸下降异常，使睾丸不能降至阴囊而停留在腹膜后、腹股沟管或阴囊入口处。隐睾最严重的后果是睾丸恶变（D对）。